妊娠早期使用可引起胎儿畸形的药品是
A. 阿莫西林
B. 氨甲环酸
C. 维生素D
D. 吗啡
E. 沙利度胺

正确答案：E。沙利度胺

解析：本题考查妊娠期妇女用药。沙利度胺（E对）在妊娠早期使用可引起胎儿肢体、耳、内脏畸形。阿莫西林（A错）不良反应为过敏反应。氨甲环酸（B错）不良反应少且轻微。维生素D（C错）无致畸作用。吗啡（D错）对胎儿不良反应为抑制呼吸。